关于脉络丛，描述正确的是
A. 是软脑膜、毛细血管和室管膜上皮共同突入脑室内形成
B. 只存在于侧脑室内
C. 与脑脊液的回流有关
D. 是脑脊液进入血液循环的途径
E. 是蛛网膜突入硬脑膜窦内形成

正确答案：A。是软脑膜、毛细血管和室管膜上皮共同突入脑室内形成

解析：脉络丛是软脑膜、毛细血管和室管膜上皮共同突入脑室内形成的结构（A对），存在于脑室系统中（B错），是产生脑脊液的主要部位（C错）。脑脊液由脑室脉络丛产生，最后经由脑蛛网膜突入硬脑膜窦内形成（E错）的蛛网膜粒渗透到硬脑膜窦内（主要是上矢状窦），回流入血液中（D错）。